眼刺激试验最常使用的动物是
A. 大鼠
B. 小鼠
C. 家兔
D. 犬
E. 豚鼠

正确答案：C。家兔